患者，男，38岁。左颧面部疔疮，根深坚硬，形如钉丁状，红肿灼痛，伴发热，恶寒，头痛等全身症状，舌红苔腻，脉滑数。其治法是
A. 清热消肿
B. 和营消肿
C. 清热凉血
D. 清热解毒
E. 和营托毒

正确答案：D。清热解毒

解析：疔是一种发病迅速，易于变化而危险性较大的急性化脓性疾病，其特点是疮形虽小，但根脚坚硬，有如钉丁之状，病情变化迅速，容易造成邪毒走散，本病例皮疹特点为左颧面部疗疮，根深坚硬，形如钉丁状，故诊断为颜面部疔疮之热毒蕴结证，治宜清热解毒：用五味消毒饮、黄连解毒汤加减（D对）。清热消肿，和营消肿，清热凉血和和营托毒不是本病的治法（ABCE错）。